对典型矽肺的X线胸片诊断时，不需要特别注意的是
A. 阴影直径及宽度的大小
B. 阴影的形态规则与否
C. 阴影的数量及密集度
D. 肺纹理在各肺区的分布
E. 胸膜、肋膈角的改变及肺气肿情况

正确答案：D。肺纹理在各肺区的分布

解析：本题考查矽肺的X线胸片。当诊断X线胸片时，可以按胸片阴影的直径及宽度的大小（A对）以及阴影的形态规则与否（B对）将症状分为圆形小阴影、不规则形小阴影、大阴影；按照阴影的数量及密集度（C对）、胸膜，肋膈角的改变及肺气肿的情况（E对）可将矽肺进行分期。肺纹理在各肺区间的分布（D错，为本题正确答案）不能作为诊断典型矽肺的X线表现。